胃癌患者肺转移途径是
A. 种植转移
B. 淋巴转移
C. 血行转移
D. 直接浸润
E. 跳跃转移

正确答案：C。血行转移